肝细胞脂肪变的是
A. 肝细胞轮廓可见，胞核浓缩，核膜消失
B. 肝细胞体积增大，双核，核仁明显
C. 肝细胞体积增大，胞质内大小不等的空泡，苏丹（﹢）
D. 肝细胞体积增大，胞质疏松，淡染，透明度增加
E. 肝细胞体积缩小，胞质疏松，透明度增加

正确答案：C。肝细胞体积增大，胞质内大小不等的空泡，苏丹（﹢）

解析：肝细胞脂肪变时，可见肝细胞体积增大，在石蜡切片中，胞质内出现大小不等的空泡，在冷冻切片中，苏丹Ⅲ、苏丹Ⅳ染色阳性（C对）。肝细胞轮廓可见，胞核浓缩，核膜消失（A错）为肝细胞嗜酸性变（P23）的病变特点。肝细胞体积增大，双核，核仁明显（B错）是肝硬化假小叶内再生肝细胞（P201）的特点。肝细胞体积增大、胞质疏松、淡染、透明度增加（DE错）是肝细胞水肿（P197）的病变特点。